有关脑和脊髓被膜的描述错误的是
A. 硬脑膜与颅底连接紧密
B. 硬脑膜在某些部位两层分开形成硬脑膜窦
C. 脊髓和脑的硬膜外腔相通
D. 蛛网膜粒与脑脊液回流有关
E. 软脑膜中含有丰富的血管

正确答案：C。脊髓和脑的硬膜外腔相通

解析：脑的被膜由外向内依次为硬脑膜、脑蛛网膜和软脑膜。硬脑膜与颅底连接紧密（A对），因而颅底骨折时，易将硬脑膜与脑蛛网膜同时撕裂，使脑脊液外漏。硬脑膜在某些部位两层分开，内面衬以内皮细胞，构成硬脑膜窦（B对），其中上矢状窦内有脑蛛网膜形成的绒毛状突起，称蛛网膜粒，脑脊液经蛛网膜粒渗入硬脑膜窦内，回流入静脉（D对）。脑和脊髓都有硬膜外腔，但两者不相通（C错，为本题正确答案）。软脑膜覆盖于脑的表面，薄且含有丰富的血管（E对）和神经。